手术室消毒的内容说法错误的是
A. 门诊手术室应与治疗室或拔牙室分开
B. 门诊手术室在连续手术时应遵循先无菌、次污染、后感染的原则
C. 手术室常用的方法有紫外线照射、电子灭菌灯消毒等方法
D. 手术室应定期进行空气消毒，一般每周应进行1次
E. 手术室可使用过氧乙酸（0.75～1g/m3）加热蒸汽消毒

正确答案：D。手术室应定期进行空气消毒，一般每周应进行1次

解析：门诊手术室应与治疗室或拔牙室分开，在连续手术时应遵循先无菌、次污染、后感染的原则，以免发生交叉感染。手术室应定期进行空气消毒，一般每日（D错）应进行1次，常用的方法有紫外线照射、电子灭菌灯消毒或化学药物加热蒸汽消毒，如过氧乙酸（0.75～1g/m3）、甲醛溶液（甲醛溶液10ml/m3加高锰酸钾5g/m3）等。本题选非，答案为D。